在常年无白喉发生的自然村中，去年秋天，突然发生白喉患者5例，在流行过程的强度上称
A. 散发
B. 暴发
C. 隐性流行
D. 流行
E. 大流行

正确答案：B。暴发

解析：本题考查暴发。暴发（B对ACD错）是指一个局部地区或集体单位中，短时间内突然出现很多症状相同的患者。这些患者多有相同的传染源或传播途径。大多数患者常同时出现在该病的最短和最长潜伏期之间。